调节体温的高级中枢位于
A. 大脑皮层
B. 海马回
C. 视前区-前下丘脑
D. 桥脑
E. 脊髓

正确答案：C。视前区-前下丘脑

解析：视前区-前下丘脑（POAH）（C对）是调节体温的高级中枢。